睫状体
A. 上皮含有丰富的色素细胞
B. 属于内膜的一部分
C. 睫状肌调节角膜凸度
D. 收缩时可缩小瞳孔
E. 可产生房水

正确答案：E。可产生房水

解析：睫状体是血管膜的一部分，且血管膜处于眼球壁的中层，故睫状体属于中膜（血管膜）的一部分，而非内膜（视网膜）的一部分（B错）。眼球壁的虹膜和脉络膜均富含色素细胞，唯独睫状体上皮无丰富的色素细胞（A错）。睫状体可产生防水（E对），并通过其内的睫状肌调节晶状体凸度，并非调节角膜凸度（C错）。收缩时可缩小瞳孔的是瞳孔括约肌，位于虹膜，而非睫状体（D错）。